肠结核最好发的部位是
A. 直肠乙状结肠
B. 降结肠
C. 横结肠
D. 升结肠
E. 回盲部

正确答案：E。回盲部

解析：肠结核由结核分枝杆菌引起，该菌易侵犯淋巴组织，而回盲部淋巴组织丰富，并且含有结核杆菌的肠内容物在回盲部停留较久，增加了局部黏膜的感染机会，所以肠结核最好发的部位是回盲部（E对），而直肠、乙状结肠（溃疡性结肠炎的好发部位）（A错）、降结肠（B错）、横结肠（C错）及升结肠（D错）等部位的肠结核发病率较低。